HIV在人群中流行的三个基本环节为
A. 传染力、致病力、毒力
B. 潜伏期、症状期、恢复期
C. 传染源、传播途径、易感人群
D. 病原体、宿主、社会
E. 病人、病原携带者、受感染动物

正确答案：C。传染源、传播途径、易感人群